男，30岁。咽疼、咳嗽、发热，2周后发现尿色红，眼睑浮肿，尿量1000ml/24h。体检：全身皮肤未见皮疹，血压150/100mmHg。化验：尿蛋白（++），红细胞50～60/HP，血白蛋白32g/L，血肌酐123μmol/L。按上述治疗2个月后，病情无好转，血肌酐300μmol/L，对诊断最有价值的进一步检查是
A. 清洁中段尿培养
B. 肾穿刺活检
C. 肾脏CT
D. 肾脏B型超声
E. 静脉肾盂造影

正确答案：B。肾穿刺活检

解析：患者初步诊断为急性链球菌感染后肾炎。按照急性链球菌感染后肾炎正规治疗后，病情无好转，且血肌酐升高到300μmol/L（正常值88.4～176.8μmol/L，提示血肌酐升高），出现肾功能减退，对诊断最有价值的进一步检查是肾穿刺活检（B对）。肾穿刺活检可以明确肾小球疾病的组织病理学改变，有助于明确诊断、指导治疗、判断预后。清洁中段尿培养（A错）是诊断尿路感染的重要依据。肾脏CT（C错）、肾脏B型超声（D错）均为影像学检查，有助于肾脏形态改变的观察。静脉肾盂造影（E错）主要用于了解肾脏、输尿管的位置，肾脏的分泌功能，腹膜后病变与泌尿系器官的关系，且有一定的肾毒性，会加重肾损害。